我国规定1岁内必须完成的计划免疫是
A. 麻疹疫苗
B. 乙脑疫苗
C. 流脑疫苗
D. 流感疫苗
E. 甲型肝炎疫苗

正确答案：A。麻疹疫苗

解析：麻疹疫苗的接种属于计划免疫，在1岁以内必须接种（A对），乙脑疫苗（B错）、流脑疫苗（C错）、流感疫苗（D错）、甲型肝炎疫苗（E错）不是我国的计划免疫。儿童计划免疫程序详见P30表3-1。